男，46岁，投资顾问，因社交焦虑接受心理治疗，在心理冶疗师的帮助下焦虑明显改善。患者心存感激，欲将掌握的投资信息告知心理治疗师以作报答，但被婉言谢绝，在此治疗关系中，该心理治疗师遵循的原则是
A. 保密性
B. 正式性
C. 单向性
D. 时限性
E. 系统性

正确答案：C。单向性

解析：心理治疗关系的建立原则有单向性、系统性、正式性、时限性。单向性（C对）是指在治疗关系中，一方是治疗者，另一方是病人、求助者。心理咨询室内咨询师和咨客是单向的关系，咨询师的职责是帮助和引导咨客解决问题，所有对话的出发点是更多的了解咨客的成长史发掘咨客问题的根源，而不是其他。该心理咨询师婉言谢绝来访者的投资信息，遵循就是单向性原则。正式性（B错）是指治疗者的目的和职责就是给患者提供帮助。时限性（D错）是指治疗关系要以目标达到为终结。系统性（E错）是指心理治疗有着明确的目的和对象。